预备嵌体洞缘斜面的目的不包括
A. 增加嵌体的边缘密合性
B. 增加嵌体的强度
C. 减少微漏
D. 预防釉质折断
E. 增加嵌体与边缘的封闭作用

正确答案：B。增加嵌体的强度

解析：本题考查预备嵌体洞缘斜面的目的。增加嵌体的强度（B错，为本题的正确答案）可以选用强度较高的材料制作嵌体，与嵌体洞缘斜面的制备无关。对于金属嵌体而言，洞缘斜面一般为45°，嵌体边缘终止在洞缘斜面上可避免因合金的铸造收缩导致边缘出现缝隙，增加嵌体的边缘密合性（A对），增加嵌体与边缘的封闭作用（E对），减少微渗漏（C对）的发生。制备洞缘斜面时去除无支持的牙釉质边缘，可预防釉质折断（D对）。